含新特戊酸酯结构的前体药物是
A. 更昔洛韦
B. 盐酸伐昔洛韦
C. 阿昔洛韦
D. 泛昔洛韦
E. 阿德福韦酯

正确答案：E。阿德福韦酯

解析：本题考查阿德福韦酯的化学结构。阿德福韦酯（E对）是阿德福韦的双新特戊酰氧基甲醇酯，是前体药物。